患者午后潮热，不欲近衣，手足心热，烦躁，少寐多梦，盗汗，口干咽燥，舌红少苔，脉细数，治法为
A. 活血化瘀
B. 解郁泻热
C. 益气养血
D. 滋阴清热
E. 和中清热

正确答案：D。滋阴清热

解析：题中患者午后潮热，不欲近衣，手足心热，诊断为内伤发热，烦躁，少寐多梦，盗汗，口干咽燥等为阴虚阳盛，虚火内炽所致，治宜滋阴清热（D对），方用清骨散。